长期保藏肉类、鱼类在何种温度才能有效抑制脂肪氧化和霉败
A. ‐30℃～‐20℃
B. ‐20℃～‐10℃
C. ‐10℃～0℃
D. 0℃～4℃
E. 以上均不对

正确答案：A。‐30℃～‐20℃